定性研究的特点是
A. 注重过程的研究
B. 注重结果的研究
C. 研究样本结果可以外推
D. 常用概率统计方法
E. 以上都是

正确答案：A。注重过程的研究

解析：本题考查定性研究的特点。定性研究也称为质性研究，是一种在自然的情境下，从整体的角度深入探讨和阐述被研究事物的特点及其发生和发展规律，以揭示事物的内在本质的一类研究方法。其特点包括：1.定性研究注重事物的过程（A对），而不是事物的结果（B错）；2.定性研究是对少数特殊人群的研究，其结果不能外推（C错）；3.定性研究需要与研究对象保持较长时间的密切接触；4.定性研究的结果很少用概率统计分析（DE错）。